关于胃肠内在神经丛的描述，正确的是
A. 包括粘膜下神经丛和肌间神经丛
B. 含大量神经纤维，但神经元不多
C. 递质仅是乙酰胆碱或去甲肾上腺素
D. 仅有运动功能，而无感觉功能
E. 不受外来自主神经系统的控制

正确答案：A。包括粘膜下神经丛和肌间神经丛

解析：支配消化道的神经包括外来神经和内在神经丛。其中内在神经丛根据其所在位置又分为黏膜下神经丛和肌间神经丛（A对），它们是由大量神经元（B错）和神经纤维组成的复杂的神经网络。内在神经丛释放的神经递质包括乙酰胆碱、血管活性肠肽（VIP）、P物质等，去甲肾上腺素是交感神经释放的（C错）。肠神经系统中的神经元包括感觉神经元（D错）、运动神经元和大量中间神经元，其感觉神经元能感受食糜成分及牵张刺激。在整体情况下，外来神经对内在神经丛具有调节作用（E错），但除去外来神经后，内在神经丛仍可在局部发挥调节作用。